职业卫生与职业医学是预防医学中的一个
A. 三级学科
B. 分支学科
C. 学派
D. 部分学科
E. 子学科

正确答案：B。分支学科